前庭阶和鼓阶的外淋巴借以下哪个结构相通
A. 前庭窗
B. 蜗窗
C. 蜗孔
D. 蜗管
E. 脑水肿

正确答案：C。蜗孔

解析：前庭窗和蜗窗分别为鼓室内侧壁的岬的后上方和后下方的小孔，在活体上，前庭窗（A错）被镫骨底及其周缘的韧带将前庭窗封闭，蜗窗（B错）由第二鼓膜封闭。蜗管（D错）位于耳蜗内，为盲管。庭阶和鼓阶内均含外淋巴，在蜗顶处借蜗孔（C对）彼此相通。